人工流产术后12日，仍有较多阴道流血，应首先考虑的是
A. 子宫穿孔
B. 子宫复旧不良
C. 吸宫不全
D. 子宫内膜炎
E. 子宫绒毛膜癌

正确答案：C。吸宫不全

解析：术后阴道流血超过10日，血量过多，或流血后又有多量流血（吸宫不全常表现为手术后阴道流血时间长，血量多或流血停止后再现多量流血），应首先考虑吸宫不全（C对）。子宫穿孔（P384）（A错）是指手术时突然感到无宫底感觉，或手术器械进入深度超过原来所测得深度。子宫复旧不良（B错）表现为突然大量阴道流血，检查发现子宫大而软，宫口松弛，阴道及宫口有血块堵塞。子宫内膜炎（P227）（D错）常表现为高热、头痛、白细胞增高、阴道脓血性分泌物等，无阴道持续流血。子宫绒毛膜癌（P338）（E错）常表现为葡萄胎排空、流产或足月产后，有持续的不规则阴道流血，量多少不定，但多继发于葡萄胎妊娠，常发生转移，组织学检查可明确诊断。